女，65岁。劳累时剑突下疼痛，因情绪激动再次发作，疼而较前加剧，含服硝酸甘油不缓解，伴恶心。糖尿病病史8年。心电图：Ⅱ、Ⅲ、aVF导联ST段弓背向上抬高伴T波倒置。最有助于明确诊断的实验室检查是
A. 尿淀粉酶
B. 尿酮体
C. 血肌酸激酶
D. 血肌钙蛋白
E. 血淀粉酶

正确答案：D。血肌钙蛋白

解析：老年女性患者，多年糖尿病病史（冠心病的危险因素），劳累时剑突下疼病（心绞痛），时前因情绪激动再次发作，疼而较前加剧（症状加重），含服硝酸甘油不缓解，伴恶心。Ⅱ、Ⅲ、aVF导联ST段弓背向上抬高伴T波倒置（STEMI特征性表现）。因此诊断为STEMI。最有助于明确诊断的实验室检查是血肌钙蛋白（D对）。肌钙蛋白I(cTnI）或T(cTnT）起病3-4小时后升高，cTnI于11-24小时达高峰，7-10天降至正常，cTnT于24-48小时达高峰，10-14天降至正常。这些心肌结构蛋白含量的增高是诊断MI的敏感指标。